在我国，引起肝硬化的主要病因是
A. 肝静脉阻塞综合征
B. 酒精性肝病
C. 药物性肝炎
D. 病毒性肝炎
E. 自身免疫性肝病

正确答案：D。病毒性肝炎